根据《药品流通监督管理办法》，下列叙述错误的是
A. 药品生产、经营企业对其药品购销行为负责
B. 药品生产、经营企业可派出销售人员以本企业名义从事药品购销活动
C. 药品生产、经营企业应对销售人员从事的药品购销行为承担法律责任
D. 药品生产、经营企业应对销售人员的销售行为作出具体规定
E. 药品生产、经营企业应加强对药品销售人员的管理

正确答案：C。药品生产、经营企业应对销售人员从事的药品购销行为承担法律责任

解析：本题考查的是药品经营行为管理。药品上市许可持有人、药品经营企业应当加强药品采购、销售人员的管理，对其进行法律法规和专业知识培训，并对其药品经营行为承担法律责任（C错，为本题正确答案）。药品经营行为管理：药品上市许可持有人不仅仅是一个只需符合药品GMP的“药品生产企业”，其药品经营行为应当严格执行药品GSP。依照《药品管理法》的规定，药品上市许可持有人对药品经营活动承担总体责任，其他从事药品购进、销售、储存、运输等经营活动的企业和个人依法承担相应的责任（A对）。药品上市许可持有人、药品经营企业法定代表人和主要负责人对药品经营活动全面负责，并应当熟悉药品经营监管的法律法规。药品上市许可持有人、药品经营企业应当加强药品采购、销售人员的管理（E对），对其进行法律法规和专业知识培训，并对其药品经营行为承担法律责任。